治疗脾肺气虚，应选用的药组是
A. 人参、党参、西洋参
B. 党参、黄芪、太子参
C. 人参、白术、山药
D. 黄芪、人参、白扁豆
E. 党参、大枣、黄精

正确答案：B。党参、黄芪、太子参

解析：党参味甘性平，主归脾、肺二经，有与人参类似的补益脾肺之气作用而药力较弱，为补中益气之良药。黄芪甘温，入脾经，为补益脾气之要药；入肺经，又能补益肺气。太子参的功效为益气健脾，生津润肺。故治疗脾肺气虚可选用党参、黄芪、太子参（B对）。西洋参的功效为补气养阴，清热生津。归心、肺、肾经（A错）。人参归脾经，为补脾气之要药；归肺经，亦长于补肺气；亦归肾经，又有益肾气、助肾阳之功。白术甘温补虚，苦温燥湿，主归脾、胃经，既能补气以健脾，又能燥湿、利尿（C错）。山药甘平，能补脾气，益脾阴；能补肺气，兼能滋肺阴。白扁豆的功效为健脾化湿，和中消暑。治疗脾胃虚弱，食欲不振，大便溏泻；暑湿吐泻，胸闷腹胀（D错）。大枣甘温，归脾、胃经，能补脾益气（E错）。黄精既补脾气，又养脾阴。又能养肺阴，益肺气。